顿咳的好发季节是
A. 春、夏
B. 春、秋
C. 夏、秋
D. 秋、冬
E. 冬、春

正确答案：E。冬、春

解析：顿咳即为百日咳，是小儿时期感受百日咳时邪引起的肺系传染病，临床以阵发性痉挛性咳嗽和痉咳末伴有较长的鸡鸣样吸气性吼声为特征，好发于冬春此寒冷季节，好发于冬春季节的还有麻疹、风疹、幼儿急疹、猩红热、水痘、流行性腮腺炎（E对）（ABCD错）。